胰腺癌首选的检查方法是
A. B超
B. X线气钡双重造影
C. CT
D. MRI
E. 血、尿淀粉酶测定

正确答案：C。CT

解析：胰腺癌首选的检查方法是CT（C对），也是胰腺癌诊断的主要方法，胰腺薄层动态增强扫描（层厚≤3mm) 是诊断胰腺疾病的最佳CT技术，能发现直径＜2.0cm 的小胰腺癌，可清楚地显示胰管和胆管的扩张情况，真实地显示肿瘤与门静脉、肠系膜血管等的毗邻关系，极大程度地提高了术前胰腺癌可切除性的预测率，CT 血管造影(CTA) 是显示胰腺相关血管病变的理想技术。B超（A错）主要用于常规检查，对胰胆管扩张比较敏感，但对胰腺常显示不清。X线气钡双重造影（B错）可发现十二指肠受壶腹部癌或胰头癌浸润和推移的影像。MRI（D错）可发现＞2cm的胰腺肿瘤，但空间分辨率较差，对早期胰腺癌的诊断较为有限。胰头癌导致胰管梗阻的早期可有血、尿淀粉酶的一过性升高（E错），但不具有特异性，不能作为诊断胰腺癌的首选检查。